急性坏死性龈炎病变区细菌学涂片增加最多的厌氧微生物是
A. 伴放线聚集杆菌与梭形杆菌
B. 梭形杆菌与中间普氏菌
C. 牙龈卟啉单胞菌与螺旋体
D. 梭形杆菌与螺旋体
E. 以上都不是

正确答案：D。梭形杆菌与螺旋体

解析：细菌学检查：病变区坏死物涂片，进行瑞氏染色，或刚果红染色，在显微镜下观察有无梭形杆菌和螺旋体。细菌学检查只是作为辅助检查方法。掌握“坏死性溃疡性龈炎”知识点。